引起皮肤水合作用最强的基质是
A. O/W型乳剂基质
B. 凡士林
C. 甘油明胶
D. W/O型乳剂基质
E. 羧甲基纤维素钠

正确答案：B。凡士林